患者，男，63岁，既往患有高血压、2型糖尿病、高脂血症。目前使用硝苯地平控释片、盐酸二甲双胍片、阿卡波糖片、瑞舒伐他汀钙片。新诊断冠心病，给予阿司匹林肠溶片，单硝酸异山梨酯缓释片治疗。单硝酸异山梨酯缓释片的给药频次是
A. 每日晨起服药1次
B. 按需服用
C. 每日4次
D. 每日3次
E. 每晚睡前服药1次

正确答案：A。每日晨起服药1次

解析：本题考查单硝酸异山梨酯的用法用量。单硝酸异山梨酯的缓释片使用方法：晨服，初始剂量一次50mg或60mg，一日1次（A对），需个体化给药。